输血过程中应先慢后快，再适当调整输注速度，并严密观察受血者有无异常情况。调整输注速度是根据受血者的
A. 病情和年龄
B. 病情和体重
C. 病情和血型
D. 体重和年龄
E. 体重和血型

正确答案：A。病情和年龄

解析：输血过程中应先慢后快，再根据病情和年龄（A对）调整输注速度，并严密观察受血者有无输血不良反应，如出现异常情况应及时处理。